为增加依从性，应该向患者介绍药物的一般知识，其中包括
A. 药物的化学结构式和合成路线
B. 根据治疗目的选择适当的给药途径
C. 药物的效期、包装及储藏保管
D. 药物的禁用、慎用、相互作用等
E. 特殊病人应遵循的特殊给药方案

正确答案：B、C、D。根据治疗目的选择适当的给药途径；药物的效期、包装及储藏保管；药物的禁用、慎用、相互作用等